下列各项，不支持流行性脑脊髓膜炎诊断的脑脊液检查是
A. 外观混浊呈脓性
B. 蛋白质含量高
C. 细胞数＜0.5×106/L,以单核细胞为主
D. 糖含量明显减少
E. 氯化物含量减少

正确答案：C。细胞数＜0.5×106/L,以单核细胞为主

解析：脑脊液检查是确诊流行性脑脊髓膜炎的重要方法。典型的脑膜炎期，压力增高，外观呈浑浊米汤样甚或脓样（A对），白细胞数明显增高至1000×10⁶/L以上，以多核细胞为主（C错，为本题正确答案），糖及氯化物明显减少（DE对），蛋白含量升高（B对）。